围产期是指
A. 孕期28周到生后l周
B. 孕期29周到生后4周
C. 孕期38周到生后2周
D. 孕期38周到生后4周
E. 孕期40周到生后4周

正确答案：A。孕期28周到生后l周

解析：该题考查围产期的定义。围产期是指怀孕28周到产后一周这一分娩前后的重要时期（A对）。